男，14岁。午餐进食海鱼后，即出现头痛头晕、胸闷，心跳呼吸加快，伴有眼结膜充血，颜面部及全身潮红。测体温正常，无呕吐、腹泻等症状。患者最可能是
A. 河豚鱼中毒
B. 组胺中毒
C. 肉毒梭菌毒素中毒
D. 麻痹性贝类中毒
E. 副溶血性弧菌中毒

正确答案：B。组胺中毒

解析：依据体重患者食用过海鱼的病史，结合临床表现：头痛头晕、胸闷，心跳呼吸加快，伴有眼结膜充血，颜面部及全身潮红无呕吐、腹泻。不难诊断出该患者是使用海鱼后的组胺中毒（B对）。河豚鱼中毒（A错）主要临床表现是口唇麻痹、恶心呕吐、腹痛腹泻、严重的有眼睑下垂、全身麻痹甚至死亡。最重要的是有河豚食用史。肉毒梭菌毒素中毒（C错）的重要标志是体温脉搏成反比，以及神经麻痹症状。麻痹性贝类中毒。麻痹性贝类中毒（D错）常以唇、舌、指尖麻木起病，重症者常因呼吸肌麻痹而死亡。副溶血性弧菌中毒（E错）临床上主要以剧烈腹痛起病，并有持续的呕吐、腹泻。